在5S循证医学信息服务模式演进的过程中，提供证据的最高形式是
A. 原始研究
B. 系统综述
C. 证据概要
D. 综合证据
E. 证据系统

正确答案：E。证据系统